用于人工被动免疫的生物制品是
A. 卡介苗
B. 类毒素
C. 抗毒素
D. 活疫苗
E. 死疫苗

正确答案：C。抗毒素